婚前医学检查的严重遗传性疾病不包括
A. 多基因遗传病
B. 常染色体显性遗传病
C. 常染色体隐性遗传病
D. 因遗传病而生活不能自理再发风险高者
E. 重型精神病

正确答案：E。重型精神病

解析：本题考查婚前医学检查的严重遗传性疾病。重型精神病（E错，为本题正确答案）不属于婚前医学检查的严重遗传性疾病。婚前医学检查的严重遗传性疾病包括：如多基因遗传病（A对）的智力低下；常染色体显性遗传病（B对）、常染色体隐性遗传病（C对）的先天性心脏病；因遗传病而生活不能自理再发风险高者（D对）等。